分子中含有噻吩丙烯酸结构，不经CYP450代谢的药物是
A. 替米沙坦
B. 氯沙坦
C. 依普罗沙坦
D. 厄贝沙坦
E. 缬沙坦

正确答案：C。依普罗沙坦

解析：本题考查AⅡ受体阻断药。依普罗沙坦（C对）含有噻吩丙烯酸结构，不经CYP450代谢，基本以原型药物形式排泄，耐受性好。